弹性模量与牙本质接近的桩是
A. 预成钛合金
B. 金合金铸造桩
C. 氧化锆桩
D. 镍铬合金铸造桩
E. 纤维桩

正确答案：E。纤维桩

解析：本题考查桩核冠的组成-桩。弹性模量与牙本质接近的桩是纤维桩（E对）。桩根据材料不同分为纤维桩、金属桩和陶瓷桩。（1）纤维桩：分为碳纤维桩、石英纤维桩与玻璃纤维桩，目前常用石英纤维桩与玻璃纤维桩，主要为预成桩，多与树脂等核材料靠树脂粘接结合。美观性好，弹性模量与牙本质接近，树脂粘接后，牙根内应力分布均匀，不易发生根折。纤维桩强度不如金属和陶瓷桩，易发生桩本身的折断，但桩折断后可磨除再修复。（2）金属桩：如金合金（B错）、钴铬合金、镍铬合金（D错）、钛合金（A错）等，按制作方法分为铸造金属桩和预成桩。铸造金属桩采用失蜡铸造法个别制作，为桩核一体的金属核桩。预成桩为预成的半成品金属桩，表面带有螺纹、锯齿等结构，与核形成机械嵌合。金属桩的优点是具有良好的机械性能，高强度，不易折断，特别是铸造金属桩与金属核为一整体，其本身的机械强度具有明显的优越性。金属桩的缺点：①弹性模量远远高于牙本质，容易导致根折；②金属的传导性会干扰磁共振成像（MRI），造成图像扭曲变形，因此MRI检查前往往需要拆除口内金属修复体。（3）陶瓷桩：主要是氧化锆桩（C错），分为CAD/CAM整体切削瓷桩和预成氧化锆瓷桩，后者与核瓷材料靠高温烧结结合。美观性好，多用于前牙修复。但其硬度高，弹性模量与金属近似，容易导致根折。